可通过接合方式传递的是
A. 染色体
B. 质粒
C. 毒力岛
D. 转座因子
E. 前噬菌体

正确答案：B。质粒

解析：结合是指细菌通过结合性质粒街道和性菌毛的中空管状结构连接沟通，将遗传物质（如质粒）从供体菌转入受体菌。掌握“细菌遗传变异的物质基础及机制”知识点。